注射破伤风抗毒素以后患者出现休克、发热、蛋白尿、血尿、淋巴结肿大等，原因可能是
A. Ⅰ型超敏反应
B. Ⅱ型超敏反应
C. Ⅳ型超敏反应
D. Ⅰ型或Ⅲ型超敏反应
E. Ⅲ型超敏反应

正确答案：D。Ⅰ型或Ⅲ型超敏反应